患者，女，49岁，诊断为带状疱疹。宜选用的外用镇痛药物是
A. 利多卡因
B. 伐昔洛韦
C. 甲钴胺
D. 加巴喷丁
E. 喷昔洛韦

正确答案：A。利多卡因

解析：本题考查带状疱疹的药物治疗。治疗PHN（带状疱疹后遗神经痛）的一线药物包括神经病理性疼痛治疗药物（卡马西平、加巴喷丁和普瑞巴林）、三环类抗抑郁药（阿米替林）和5%利多卡因（A对）贴剂，二线药物包括阿片类药物。